不属于虚证的临床症状是
A. 疼痛喜按
B. 心悸气短
C. 呼吸喘促
D. 自汗盗汗
E. 五心烦热

正确答案：C。呼吸喘促

解析：本题考查实证的临床表现。不属于虚证的临床症状是呼吸喘粗（C对）。实证的临床表现及辨证要点：由于实邪的性质及所在部位的不同，实证的临床表现亦极不一致。主要有：发热，腹胀痛拒按，胸闷烦躁甚至神昏谵语，呼吸喘粗，痰涎壅盛，大便秘结，小便不利，脉实有力，舌苔厚腻等。以症状表现有余、亢盛为辨证要点。虚证和实证的鉴别：虚，指正气不足。虚证便是由正气不足所表现的证候。实，指邪气过盛。实证便是由邪气过盛所表现的证候。一般来说，外感初期，证多属实；内伤久病，证多属虚。临床症状表现有余、亢盛的，属实；表现为不足、虚弱的，属虚。其中声音气息强者为实，弱者为虚。疼痛喜按（A错）为虚，拒按为实。舌质苍老为实，胖嫩为虚。脉实有力为实，脉弱无力为虚。虚证的临床表现：虚证有阴虚、阳虚、气虚、血虚等多种证候的不同，所以临床表现亦极不一致，很难概括全面。常见的有：面色苍白或萎黄，精神萎靡，身疲乏力，心悸气短（B错），形寒肢冷或五心烦热（E错），自汗盗汗（D错），大便滑脱，小便失禁，舌上少苔无苔，脉虚无力等。总之，以症状表现为不足、虚弱为辨证要点。